下列关于青蒿素结构和性质的说法，错误的是
A. 结构中有过氧键，遇碘化钾试液氧化析出碘，加淀粉指示剂，立即显紫色
B. 属于倍半萜内酯类化合物
C. 内过氧化物活性是必需的
D. 青蒿素是半合成的药物
E. 青蒿素的C-10碳基还原得到的二氢青蒿素仍有抗疟作用

正确答案：D。青蒿素是半合成的药物

解析：本题考查青蒿素。下列关于青蒿素结构和性质的说法，错误的是青蒿素是半合成的药物（D错，为本题正确答案）。青蒿素为我国科学家屠呦呦等在1971年首次从菊科植物黄花蒿中分离提取的新型结构的过氧化物倍半萜内酯（B对），不完全属于半合成药物。青蒿素结构中有过氧键，遇碘化钾试液氧化析出碘，加淀粉指示剂，立即显紫色（A对）。内过氧化结构的存在对活性是必需的（C对），脱氧青蒿素（双氧桥被还原为单氧）就完全丧失了抗疟活性。以青蒿素为先导化合物相继合成或半合成了大量的衍生物。其中将C-10羰基还原得到的双氢青蒿素，抗疟作用比青蒿素强一倍（E对）。